阈电位是
A. 造成膜对K⁺通透性突然增大的临界膜电位
B. 造成膜对K⁺通透性突然减小的临界膜电位
C. 造成膜对Na⁺通透性突然增大的临界膜电位
D. 造成膜对Na⁺通透性突然减小的临界膜电位
E. 超极化到刚引起动作电位时的临界膜电位

正确答案：C。造成膜对Na⁺通透性突然增大的临界膜电位